女性，38岁。健康查体发现右前上纵隔椭圆形阴影，边界清晰，密度均匀，与周围组织界线明显，首先考虑诊断可能是
A. 胸腺瘤
B. 淋巴瘤
C. 神经源性肿瘤
D. 心包囊肿
E. 支气管囊肿

正确答案：A。胸腺瘤

解析：患者查体见椭圆形阴影位于前上纵隔，边界清晰，与周围组织界限明显，首先考虑诊断可能是胸腺瘤（A对）。胸腺瘤好发于前上纵隔，呈椭圆形阴影或分叶状，边缘界限清楚，患者表现与之相符。淋巴瘤（B错）多为恶性，常呈双侧性且不规则，多位于后上纵隔。神经源性肿瘤（C错）多位于后纵膈脊柱旁肋脊区内；心包囊肿（D错）多位于中纵膈；支气管囊肿（E错）多位于后纵隔，均为该患者表现不相符，故不选。